下列有关信度与效度关系的不正确描述是
A. 信度不高，效度也不高
B. 信度高，不一定效度也高
C. 信度高，效度一定也高
D. 效度不高，信度可能高，也可能不高
E. 效度高，信度一定高

正确答案：C。信度高，效度一定也高